以下哪一项属于牙齿松动最主要的原因
A. 牙周炎引起的牙槽嵴的吸收
B. （牙合）创伤
C. 牙周韧带的急性炎症
D. 牙周翻瓣手术后
E. 女性激素水平的变化

正确答案：A。牙周炎引起的牙槽嵴的吸收

解析：牙槽骨吸收：是牙周炎的另一个主要病理变化。由于牙槽骨的吸收，使牙齿的支持组织高度降低，牙齿逐渐松动，最终脱落或拔除。掌握“慢性牙周炎的病因，表现诊断及预后”知识点。